根据《中药保护品种条例》，可以申请中药一级保护品种的是
A. 国家一级保护野生药材物种
B. 已申请专利的中药品种
C. 对特定疾病有特殊疗效的中药品种
D. 从天然药物中提取的有效物质及特殊制剂
E. 对特定疾病有显著疗效的中药品种

正确答案：C。对特定疾病有特殊疗效的中药品种

解析：本题考查申请中药一级保护品种的条件。根据《中药保护品种条例》，可以申请中药一级保护品种的是对特定疾病有显著疗效的中药品种（C对）。申请中药一级保护品种应具备的条件：符合下列条件之一的中药品种，可以申请一级保护。①对特定疾病有特殊疗效的；②相当于国家一级保护野生药材物种的人工制成品；③用于预防和治疗特殊疾病的。申请中药二级保护品种应具备的条件：符合下列条件之一的中药品种，可以申请二级保护。①符合上述一级保护的品种或者已经解除一级保护的品种；②对特定疾病有显著疗效的（E错）；③从天然药物中提取的有效物质及特殊制剂（D错）。